关于注射用水的说法，错误的是
A. 为纯水经蒸馏所得的水
B. 用于配制注射剂的溶剂
C. 作为配制滴眼剂的溶剂
D. 用作注射剂容器的精洗
E. 用作注射用无菌粉末的溶剂

正确答案：E。用作注射用无菌粉末的溶剂

解析：本题考查的是注射用水的相关知识。灭菌注射用水主要用于注射用灭菌粉末的溶剂（E错，为本题正确答案）。灭菌注射用水：灭菌注射用水为注射用水按照注射剂生产工艺制备所得，不含任何添加剂。主要用于注射用灭菌粉末的溶剂或注射剂的稀释剂。其质量应符合《中国药典》灭菌注射用水项下的规定。灭菌注射用水灌装规格应适应临床需要，避免大规格、多次使用造成的污染。注射用水为纯化水经蒸馏所得到的水（A对），应符合细菌内毒素试验要求。注射用水必须在防止细菌内毒素产生的设计条件下生产、贮藏及分装。其质量应符合《中国药典》注射用水项下的规定。注射用水可作为配制注射剂（B对）、滴眼剂（C对）等的溶剂或稀释剂及容器的精洗（D对）。